单位时间内胃内容物的排出量
A. 胃排空速率
B. 肝肠循环
C. 首过效应
D. 代谢
E. 吸收

正确答案：A。胃排空速率

解析：本题考查胃排空速率。胃排空速率（A对）是指单位时间内胃内容物从胃幽门部排至小肠上部的量；肠肝循环（B错）是经胆汁或部分经胆汁排入肠道的药物,在肠道中又重新被吸收,经门静脉又返回肝脏的现象；首过效应（C错）是口服药物经胃肠道和肝脏代谢，进入血液循环的量减少的现象；代谢（D错）是生物体内所发生的用于维持生命的一系列有序的化学反应的总称；吸收（E错）是药物由给药部位进入血液循环的过程。